下列药物中与血浆蛋白结合率高，分布容积随年龄增长而降低，易造成老年人血药浓度升高而中毒的是
A. 巴比妥
B. 维生素C
C. 碳酸钙
D. 地西泮
E. 水杨酸钠

正确答案：D。地西泮